抗瘤谱广，常用于治疗各种实体瘤的药物是
A. 阿霉素
B. 放线菌素D
C. 环磷酰胺
D. 丝裂霉素
E. 紫杉醇

正确答案：A。阿霉素

解析：本题考查抗肿瘤药。抗瘤谱广，常用于治疗各种实体瘤的药物是阿霉素（A对）。阿霉素又称多柔比星，抗瘤谱广，用于恶性淋巴瘤、乳腺癌、支气管肺癌和软组织肉瘤、成骨肉瘤、横纹肌肉瘤、尤文肉瘤、肾母细胞瘤、神经母细胞瘤等实体瘤。放线菌素D（B错）对霍金奇病、绒毛膜癌和肾母细胞瘤有较好的疗效。环磷酰胺（C错）主要适用于恶性淋巴瘤、急性或慢性淋巴细胞白血病、多发性骨髓瘤，还可以用于自身免疫性疾病的治疗。丝裂霉素（D错）主要用于胃癌、结肠及直肠癌、肺癌、胰腺癌、肝癌、宫颈癌、宫体癌、乳腺癌、头颈区肿瘤、膀胱肿瘤。紫杉醇（E错）为治疗卵巢癌和乳腺癌的一线药物。